传统根尖手术去骨的范围一般在
A. 10mm以上
B. 20mm以上
C. 40mm以上
D. 50mm以上
E. 80mm以上

正确答案：A。10mm以上

解析：本题考查根尖手术。传统根尖手术去骨的范围一般在10mm以上（A对），而在显微镜及显微器械的帮助下，只需去除约4～5mm大小的骨质，便可得到清楚的视野和足够的操作范围。